组织社区活动是
A. 致力于帮助并鼓励人们有达到健康状态的愿望，知道怎样做才能达到这样的目的，促进每个人或集体努力做好本身应做的一切，知道在必要时如何寻求适当的帮助
B. 其目的是使人认识到并能终生保持口腔健康，通过采用教育手段促使人们主动采取利于口腔健康的行为
C. 为改善环境使之适合于保护口腔健康或使行为有利于口腔健康采取的各种行政干预、经济支持和组织保证等措施
D. 就口腔健康问题与预防保健问题与患者、领导、家长、居委会成员、保健人员进行交谈、讨论的方法
E. 属于街道居民区、乡村及社会团体与单位的活动，旨在使人们提高对口腔健康的认识，引起兴趣，产生强烈的口腔健康愿望

正确答案：E。属于街道居民区、乡村及社会团体与单位的活动，旨在使人们提高对口腔健康的认识，引起兴趣，产生强烈的口腔健康愿望

解析：社区活动：城市街道、农村乡镇和社会团体与单位（企业、学校、机关）的有组织活动，使人们提高对口腔健康的认识，引起兴趣，产生强烈愿望，强化口腔健康服务资源的利用。通常是进行口腔健康调查，了解对口腔健康的需求，为制订计划打下基础，在制订计划过程中有意识地对不同层次的人进行教育，以增强目标人群对实施教育计划的责任感。掌握“口腔健康教育”知识点。